下列关于手足口病的叙述，正确的是
A. 皮疹向心性分布
B. 疹退后局部有瘢痕
C. 疱疹壁薄易破，胞浆清亮
D. 疹退后在皮疹部位有色素沉着
E. 皮疹以口腔、四肢为主，口腔疱疹破溃后形成溃疡

正确答案：E。皮疹以口腔、四肢为主，口腔疱疹破溃后形成溃疡

解析：手足口病是由感受手足口病时邪（柯萨奇病毒A组）引起的发疹性传染病，临床以手足肌肤、口咽部发生疱疹为特征，辨证要点为皮疹呈离心性分布（A错），质地较硬，多不易破溃（C错），而口腔的疱疹一旦破溃后会形成溃疡（E对），疼痛剧烈，疹退后无瘢痕及色素沉着（BD错）。